阴虚火旺之盗汗,首选方剂是
A. 当归六黄汤
B. 玉屏风散
C. 生脉散
D. 牡蛎散
E. 桂枝汤

正确答案：A。当归六黄汤

解析：阴虚火旺之盗汗,首选方剂是当归六黄汤。功用滋阴泻火，固表止汗。本方为治疗阴虚火旺盗汗之常用方（A对）。玉屏风散主治表虚自汗（B错）。生脉散主治温热、暑热，耗气伤阴证，久咳伤肺，气阴两虚证（C错）。牡蛎散主治体虚自汗、盗汗证（D错）。桂枝汤主治外感风寒表虚证（E错）。